出现“三偏”征，常见的病变部位是
A. 内囊
B. 脑皮质
C. 脑干
D. 脊髓
E. 基底节

正确答案：A。内囊

解析：“三偏”征是指偏瘫、偏身感觉障碍、偏盲，发病急骤，以突然晕倒、不省人事，伴口角歪斜、语言不利、半身不遂为临床主症的疾病，常见于内囊（A对）病变。脑皮质（B错）临床特点为对侧单瘫或面瘫。脑干（C错）的临床特点为交叉瘫，即病灶平面同侧脑神经周围性瘫痪，病灶侧对侧肢体中枢性瘫痪。脊髓（D错）损伤的临床特点是双下肢中枢性瘫。基底节（E错）损伤会产生一些列的自主性运动障碍。